保证手术效果的基础是
A. 手术层次清楚、逐层剖入
B. 主刀与助手要相互配合，作好组织的牵引
C. 首先应熟悉局部解剖，具有明确的解剖概念
D. 组织损伤小，动作要求细巧、准确
E. 避免过度用力，以减少组织撕裂伤

正确答案：C。首先应熟悉局部解剖，具有明确的解剖概念

解析：分离是显露组织的解剖部位、保护正常和重要组织、切除病变组织从而完成手术的重要手段。解剖分离应在正常组织层次中进行，即做到手术层次清楚、逐层剖入。为此，首先应熟悉局部解剖，具有明确的解剖概念，这是保证手术效果的基础。掌握“口外手术组织切开、止血及组织分离”知识点。